男性，37岁，急刹车致使方向盘挤压上腹部16小时，上腹部腰部及右肩疼痛，持续性，伴恶心呕吐。查体：体温38.4℃，上腹部肌紧张明显，有压痛，反跳痛不明显，无移动性浊音，肠鸣音存在，怀疑胰腺损伤。如果处理不当，最可能的远期并发症是
A. 胆总管狭窄
B. 胰腺真性囊肿
C. 脂肪泻
D. 胰腺假性囊肿
E. 横结肠梗阻

正确答案：D。胰腺假性囊肿

解析：胰腺损伤如果处理不当，使渗出的胰液积聚在网膜囊内，之后，渗液被肉芽或纤维组织（囊壁）包裹即形成胰腺假性囊肿（D对）。假性囊肿常发生于胰腺损伤后的3～4周。胰腺损伤较少合并胆总管损伤，因此一般不会并发胆总管狭窄（A错）。胰腺真性囊肿（八版外科学P488）（B错）包括先天性囊肿和潴留性囊肿，前者是由胰管系统先天性畸形所致，多见于婴幼儿，常为多发性；后者多由于胰管阻塞所致，如急慢性胰腺炎、胰管外压迫等。脂肪泻（C错）是慢性胰腺炎的并发症；横结肠梗阻（E错）是胰腺假性囊肿的并发症。